PaCO₂原发性增高见于
A. 代谢性酸中毒
B. 呼吸性酸中毒
C. 代谢性碱中毒
D. 呼吸性碱中毒
E. 酸碱平衡正常

正确答案：B。呼吸性酸中毒

解析：PaCO₂原发性增高见于呼吸性酸中毒，这是由于CO2排出障碍或吸入过多导致CO₂在体内潴留所导致。